根据《中共中央、国务院关于深化医疗保障制度改革的意见》，力争到2030年全面建成多层次医疗保障制度体系。多层次医疗保障制度体系中发挥公平普惠保障作用的是
A. 补充医疗保险
B. 医疗互助
C. 医疗救助
D. 基本医疗保险

正确答案：D。基本医疗保险

解析：本题考查多层次医疗保障制度体系的组成及作用。根据《中共中央国务院关于深化医疗保障制度改革的意见》，力争到2030年全面建成多层次医疗保障制度体系。多层次医疗保障制度体系中发挥公平普惠保障作用的是基本医疗保险（D对）。基本医疗保险覆盖城乡全体居民，公平普惠保障人民群众基本医疗需求。基本医疗保险、补充医疗保险与医疗救助具有保障功能，基本医疗保险是保障体系主体，医疗救助（C错）在保障体系中发挥托底作用，补充医疗保险（A错）、商业健康保险、慈善捐赠、医疗互助（B错）等是重要组成。